属于冠状动脉性心脏病主要危险因素是
A. 饮咖啡
B. 吸烟
C. 酗酒
D. 水污染
E. 生活节奏加快

正确答案：B。吸烟

解析：冠状动脉性心脏病主要危险因素是吸烟（B对），冠状动脉性心脏病的危险因素还包括高脂血症、高血压、遗传、性别与年龄、代谢综合征等。